角化囊肿好发于
A. 上颌前牙区
B. 上颌磨牙区
C. 上颌尖牙区
D. 下颌升支及磨牙区
E. 下颌前牙区

正确答案：D。下颌升支及磨牙区

解析：本题考查角化囊肿的好发部位。角化囊肿是牙源性角化囊性瘤的旧称，可发生于颌骨的任何部位，好发于下颌支部及第三磨牙区（D对）。上颌前牙区好发根端囊肿、非牙源性囊肿如球上颌囊肿和正中囊肿等（A错）。上颌磨牙区角化囊肿发生率较低（B错）。上颌尖牙区好发含牙囊肿、牙源性腺样瘤等（C错）。下颌前牙区好发下颌正中囊肿（E错）。